感染源直接将病原微生物传播给易感宿主
A. 直接接触传播
B. 间接接触传播
C. 飞沫传播
D. 空气传播
E. 性传播

正确答案：A。直接接触传播

解析：直接接触：感染源直接将病原微生物传播给易感宿主。直接接触血液或其他血液污染的体液（如唾液）是引起血源性传染病直接传播的主要途径。口腔医务人员反复暴露于血液与唾液，尽管有时肉眼看不见唾液中的血液，也可能已被血液污染，引起血源性疾病直接传播的风险较高，因此手套是口腔检查与治疗必不可少的防护用品。掌握“口腔医疗保健中的感染”知识点。